男性，70岁。下楼时不慎摔伤右髋部。查体：右下肢缩短，外旋50°畸形，右髋肿胀不明显，但有叩痛。为证实诊断首先要的检查是
A. 普通X线片
B. CT检查
C. MRI检查
D. 核素骨扫描
E. 关节造影

正确答案：A。普通X线片

解析：老年男性患者，右髋部摔伤后，右下肢缩短、外旋50°畸形（提示可能为股骨颈骨折）、叩痛，结合患者病史、临床表现及体查结果，该患者最可能的诊断为右股骨颈骨折。骨折确诊首选检查方法为普通X线片（A对）。CT检查（B错）、MRI检查（C错）虽对骨折显示的分辨率较高，但价格昂贵，多不作为首选检查。核素骨扫描（D错）多用于恶性肿瘤骨转移骨肿瘤的诊断。关节造影（E错）多用于关节内病变的检查。